口腔红斑病还有以下名称，除了
A. 赤斑
B. 红色增殖性病变
C. 多形性红斑
D. 增殖性红斑
E. 奎来特红斑

正确答案：C。多形性红斑

解析：本题考查口腔红斑病。口腔红斑病还有以下名称，除了多形性红斑（C错，为本题的正确答案）。口腔红斑病属于口腔斑纹类疾病，多形性红斑属于超敏反应性疾病。口腔红斑病被国内文献及教科书曾译为赤斑（A对），而与炎症性红斑相区别。口腔红斑病也称为增殖性红斑（D对）、红色增殖性病变（B对）等。奎来特于1911年提出此病，故也称为奎来特红斑（E对）。